患者，男，52岁。患支气管哮喘20年，冠心病6年。5月1日游园时突感咽痒，胸闷憋气，很快出现呼吸困难而送至急诊。查体：端坐呼吸，口唇发绀，桶状胸廓，心率108次/分，肺动脉瓣第二心音大于主动脉辦第一心音，双肺满布哮鸣音，舌暗红苔薄黄，脉弦滑。其诊断是
A. 实喘
B. 虚喘
C. 热哮
D. 寒哮
E. 以上均非

正确答案：C。热哮

解析：患者素体热盛，痰从热化，或伏痰遇风热外感，或嗜食酸咸甘肥，积痰蒸热，热痰蕴肺，壅阻气道，肺失宣降，肺管狭窄，发为哮喘。痰热壅阻气道，肺失清肃，肺气上逆，故见胸闷憋气，呼吸困难，端坐呼吸，双肺满布哮鸣音；舌暗红苔薄黄，脉弦滑为痰热蕴肺之侯，故可诊断为热哮（C对）。喘证（A错）（B错）以呼吸困难、甚则张口抬肩，不能平卧为主要症状；寒哮（D错）表现为呼吸急促，喉中哮鸣有声，面色晦滞带青，形寒肢冷，口不渴，或渴喜热饮，天冷或受寒易发。